颗粒和大分子物质通过生物膜的方式
A. 简单扩散
B. 滤过
C. 胞饮
D. 易化扩散
E. 膜动转运

正确答案：E。膜动转运